益母草的功效是
A. 清热燥湿
B. 利胆退黄
C. 凉血止血
D. 利尿消肿
E. 清肝明目

正确答案：D。利尿消肿

解析：本题考查的是益母草的功效。益母草的功效是活血祛瘀，利尿消肿（D对）。益母草：【功效】活血祛瘀，利尿消肿，清热解毒。秦皮：【功效】清热解毒，燥湿（A错）止带，清肝明目（E错）。郁金：【功效】活血止痛，行气解郁，凉血清心，利胆退黄（B错）。北刘寄奴：【功效】活血祛瘀，通经止痛，凉血止血（C错），清热利湿。